桡腕关节的特点是
A. 属椭圆关节
B. 由远侧列腕骨构成关节头
C. 桡、尺骨下端构成关节窝
D. 关节囊紧张
E. 仅能作屈、伸运动

正确答案：A。属椭圆关节

解析：桡腕关节属于典型的椭圆关节（A对），由手的舟骨、月骨和三角骨的近侧关节面作为关节头（B错），桡骨的腕关节面和尺骨头下方的关节盘作为关节窝（C错）而构成，关节囊松弛（D错），前后、两侧均有韧带加强。可以做屈、伸展、收和环转运动（E错）。